应用异烟肼抗结核，合用维生素B₆的目的是
A. 增强疗效
B. 延缓耐药性的产生
C. 延长异烟肼的作用时间
D. 减轻神经系统不良反应
E. 预防过敏反应

正确答案：D。减轻神经系统不良反应

解析：异烟肼常见的不良反应为周围神经炎，表现为手脚麻木、肌肉震颤和步态不稳等，大剂量可出现头痛、头晕、兴奋和视神经炎，严重时可导致中毒性脑病和精神病，此作用是由于异烟肼的结构与维生素B₆相似，使维生素B₆排泄增加而导致体内缺乏，维生素B₆的缺乏会引起中枢抑制性神经递质γ-氨基丁酸（GABA）减少，引起中枢过度兴奋，因此使用异烟肼时应注意及时补充维生素B₆，可减轻神经系统的不良反应（D对），对异烟肼的疗效（A错）以及耐药性（B错）、作用时间（C错）和过敏反应（E错）的发生无影响。